注射破伤风抗毒素血清治疗破伤风为
A. 应用生物应答调节剂进行免疫治疗
B. 应用细胞因子拮抗剂的治疗
C. 应用细胞因子的治疗
D. 过继免疫治疗
E. 应用抗体进行免疫治疗

正确答案：E。应用抗体进行免疫治疗